重金属检查法中，若以硫代乙酰胺作显色剂，溶液最适pH值是
A. 3～3.5
B. 4～4.5
C. 5～5.5
D. 6～6.5
E. 7～7.5

正确答案：A。3～3.5